地下水一旦遭受明显污染，即使查明了污染原因并消除了污染来源，地下水水质仍需较长时间才能恢复。其原因是多方面的，以下叙述中哪项是不正确的
A. 地下水微生物含量少，自净能力较差
B. 地下水污染过程缓慢，被地层阻留的污染物还会源源不断地释放到地下水中
C. 地下水复氧能力差、溶解氧含量低，不利于地下水污染的自净
D. 地下水流动极其缓慢，污染物不易被稀释
E. 污染物进入地下水后沉淀作用强、易沉入水体底质，形成较高浓度的污染带

正确答案：E。污染物进入地下水后沉淀作用强、易沉入水体底质，形成较高浓度的污染带

解析：本题考查地下水水质需较长时间恢复的原因。地下水一旦遭受明显污染，即使查明了污染原因并消除了污染来源，地下水水质仍需较长时间才能恢复。其原因有：地下水微生物含量少，自净能力较差（A对）；地下水污染过程缓慢，被地层阻留的污染物还会源源不断地释放到地下水中（B对）；地下水复氧能力差、溶解氧含量低，不利于地下水污染的自净（C对）；地下水流动极其缓慢，污染物不易被稀释（D对）。污染物进入地下水后，沉淀作用不一定强，也不一定易沉入水体底质，而且污染物的沉淀作用受到污染物的性质、污染物的浓度、水体的流动速度等多种因素的影响，不一定会形成较高浓度的污染带（E错，为本题正确答案）。